阿米巴痢疾实验室检查首选
A. 脑脊液涂片镜检
B. 血液涂片镜检
C. 胸水涂片镜检
D. 痰涂片镜检
E. 大便涂片镜检

正确答案：E。大便涂片镜检

解析：痢疾的实验室检查首选大便涂片镜检（E对）。脑脊液检查是明确诊断流脑的重要方法（A错）。